药用部位为发酵加工品的药材是
A. 绿豆衣
B. 大豆黄卷
C. 莲子心
D. 龙眼肉
E. 淡豆豉

正确答案：E。淡豆豉

解析：本题考查的是种子类中药的药用部位。药用部位为发酵加工品的药材是淡豆豉（E对）。种子类中药：药用部位为种子、种子的一部分或种子的加工品，这类中药称为种子类中药。种子类中药的药用部位大多是完整的成熟种子，包括种皮和种仁两部分；种仁又包括胚乳和胚。也有少数用种子的一部分，如绿豆衣（A错）为种皮，肉豆蔻衣、龙眼肉（D错）为假种皮，肉豆蔻为除去种皮的种仁，莲子心（C错）为幼叶及胚根。极少数为成熟种子的加工品，如大豆黄卷（B错）为发芽种子（经发芽干燥的加工品），淡豆豉为发酵加工品。